请患者说明斧头和锯子的共同点与不同之处，主要是检查患者的
A. 记忆力
B. 思维的判断能力
C. 思维的抽象概括能力
D. 思维的理解力
E. 学习能力

正确答案：C。思维的抽象概括能力

解析：思维抽象概括能力是人们在认识活动中运用概念、判断、推理等思维形式，对客观现实进行间接的、概括的反映的过程。请患者说明斧头和锯子的共同点与不同之处，主要是检查患者的思维抽象概括能力（C对）。